龙骨可用于
A. 肝阳上亢证
B. 神志不安证
C. 肠燥便秘证
D. 崩漏带下证
E. 虚汗不止证

正确答案：A、B、D、E。肝阳上亢证；神志不安证；崩漏带下证；虚汗不止证

解析：本题考查的是龙骨的主治病证。龙骨的主治病证有肝阳上亢证（A对）、神志不安证（B对）、崩漏带下证（D对）与虚汗不止证（E对）。龙骨：【主治病证】（1）心神不安，心悸失眠，惊痫，癫狂。（2）肝阳上亢之烦躁易怒、头晕目眩。（3）自汗，盗汗，遗精，带下，崩漏。（4）湿疮湿疹，疮疡溃后不敛。柏子仁：【主治病证】（1）虚烦不眠，心悸怔忡。（2）肠燥便秘（C错），阴虚盗汗。